生产中锰主要以下列哪种形式经呼吸道吸收而引起中毒
A. 锰尘和锰蒸气
B. 锰烟和锰蒸气
C. 锰烟和锰雾
D. 锰烟和锰尘
E. 以上都不是

正确答案：D。锰烟和锰尘